属于器官非特异性自身免疫性疾病的是
A. 重症肌无力
B. 类风湿性关节炎
C. 1型糖尿病
D. 甲状腺功能亢进症（Graves病）
E. 桥本甲状腺炎（慢性甲状腺炎）

正确答案：B。类风湿性关节炎